喷托维林的作用是
A. 抑制咳嗽的冲动传入
B. 抑制咳嗽中枢
C. 稳定肥大细胞膜
D. 激动气管 β受体
E. 溶解气饯内黏液

正确答案：B。抑制咳嗽中枢

解析：本题考查喷托维林。喷托维林是中枢性镇咳药，可选择性地抑制延髓咳嗽中枢（B对）而发挥镇咳作用。用于上呼吸道感染引起的无痰干咳和百日咳等，对小儿疗效优于成人。